邻（牙合）面洞填充3周后填充物折裂，无咬合痛，可以排除的原因是
A. 鸠尾峡过窄
B. 轴髓线角过锐
C. 邻面洞的龈壁深度不够
D. 过早受力
E. 有咬合高点

正确答案：E。有咬合高点

解析：本题考查充填体折断、脱落的原因。充填物存在高点易使充填物折裂，该患牙无咬合痛，说明该患牙无咬合高点存在（E错，为本题的正确答案）。鸠尾峡过窄，导致抗力形不佳，充填物受力不均匀，可致充填物脱落或折裂（A对）。轴髓线角过锐，使传向牙体组织的应力集中而致充填物折裂（B对）。邻面洞的龈壁深度不够，导致充填材料过薄，无足够的强度承受咀嚼压力而致充填物折裂（C对）。材料未完全固化前，其机械强度差，过早受力易折断（D对）。